右手中指受伤，3日后到医院就诊，查中指肿胀，发热，有波动感，最恰当的处理是
A. 热盐水浸泡患指
B. 抗菌药物静脉注射
C. 肌注杜冷丁25毫克
D. 中指侧面纵形切口引流
E. 患指理疗

正确答案：D。中指侧面纵形切口引流

解析：患者手指伤后出现手指肿胀、发热及波动感等表现，提示为手指化脓性感染。中指肿胀并有波动感提示脓肿形成并已成熟，应立即行中指侧面纵形切口引流（D对），以免指骨受压坏死和发生骨髓炎。热盐水浸泡患指（A错）、用抗菌药物静脉注射（B错）或患指理疗（E错）均为化脓性感染早期采取的保守治疗措施。肌注度冷丁25毫克（C错）可极大的缓解疼痛，但因其成瘾性临床上一般慎用。